牙周治疗的总体目标是
A. 消除炎症，使牙周破坏停止
B. 恢复牙周组织形态
C. 恢复牙周组织的功能
D. 维持疗效，防止复发
E. 以上均是

正确答案：E。以上均是

解析：本题考查牙周病治疗的总体目标。牙周病治疗的总体目标：（一）控制菌斑和消除炎症（A对）：菌斑是牙周病的始动因子，细菌及其毒性产物可引起牙龈的炎症和肿胀，并可进一步发展成为牙周炎，使牙周组织破坏。菌斑即使被去除，也还会不断地在牙面重新形成，必需控制菌斑。（二）恢复牙周组织的功能（C对）：（1）恢复或提高自然牙的咀嚼效能；（2）修复缺牙；（3）调整咬合关系；（4）纠正不良咬合习惯。（三）恢复牙周组织的生理形态（B对）：（1）恢复牙龈和骨组织形态；（2）恢复牙齿及邻接关系。（四）维持长期疗效、防止复发（D对）：牙周治疗计划执行过程中，对患者进行反复细致的、有针对的口腔卫生指导，坚持自我控制菌斑，并劝其戒烟、定期复查、复治使疗效得以巩固，以求长期或终生保存牙齿。（ABCD均对，故E为本题的正确答案）。